放射性骨髓炎临床表现错误的是
A. 开口受限
B. 口臭明显
C. 瘘管形成
D. 死骨暴露
E. 刀割样疼痛

正确答案：E。刀割样疼痛

解析：本题考查放射性骨髓炎临床表现。刀割样疼痛（E错，为本题正确答案）不符合放射性骨髓炎临床表现。放射性骨髓炎主要临床症状表现为为局部间断性疼痛，开口受限（A对），牙龈和周围软组织发生蜂窝织炎，有瘘管形成（C对），口臭明显（B对），死骨暴露（D对）。